“医乃仁术”指医学伦理学是
A. 医学的本质特征
B. 医学活动中的一般现象
C. 医学的非本质要求
D. 医学的个别性质
E. 个别医务人员的追求

正确答案：A。医学的本质特征